下列病情，宜选用抗菌药物治疗的是
A. 腹部受凉引起的腹泻
B. 大肠杆菌引起的肠炎
C. 鱼、虾等过敏引起的变态反应
D. 胰腺外分泌功能不足引起的腹泻
E. 婴幼儿春季流行性腹泻

正确答案：B。大肠杆菌引起的肠炎

解析：本题考查抗菌药的治疗。大肠杆菌引起的肠炎（B对）为感染性腹泻，应联合抗菌药物。腹部受凉引起的腹泻（A错）一般不需要药物治疗。鱼、虾等过敏引起的变态反应（C错）为自身免疫反应，不需应用抗菌药；胰腺外分泌功能不足引起的腹泻（D错）为消化不良性腹泻，应服用消化酶治疗；病毒性腹泻（E错）应服用抗病毒药。